健康管理是的核心环节要素组成的动态循环过程是
A. 检测-评价-干预-再评价
B. 评价-检测-干预-再评价
C. 检测-评价-再评价-干预
D. 检测-干预-评价-再评价
E. 评价-检测-再评价-干预

正确答案：A。检测-评价-干预-再评价